女，30岁。低热腹胀腹痛1个月。查体：腹部弥漫压痛，揉面感，移动性浊音阳性，对诊断最有意义的检查是
A. 结核菌素试验
B. 血清结核抗体
C. 血沉
D. 腹腔穿刺抽液检验
E. 血常规

正确答案：D。腹腔穿刺抽液检验

解析：中青年女性患者，低热（结核毒血症状）、腹胀、腹痛1个月。查体：腹部弥漫压痛，揉面感（结核性腹膜炎的典型体征），移动性浊音阳性（腹水阳性）。综合患者病史与体检，考虑诊断为结核性腹膜炎。腹腔穿刺抽液检验（D对）可鉴别腹水性质、测定ADA（腺苷脱氨酶），是对该患者诊断最有意义的检查。结核菌素试验（A错）和血清结核抗体（B错）阳性说明患者曾感染过结核分枝杆菌，并不能确诊为结核性腹膜炎。血沉（C错）增高可见于多种疾病，如急性炎症、白血病、结缔组织病及结核病的活动期，不具有特异性。血常规（E错）可用于鉴别患者的发热原因，对结核性腹膜炎的诊断价值不大。